女，60岁，因车祸骨折卧床一个月，突发胸痛，烦躁不安，呼吸困难，听诊肺动脉瓣区P₂亢进，此患者应该诊断为
A. 肺栓塞
B. 坠积性肺炎
C. 冠状动脉粥样硬化性心脏病
D. 胸腔积液
E. 主动脉夹层

正确答案：A。肺栓塞

解析：女，60岁，因车祸骨折卧床一个月（长期卧床属于肺栓塞常见危险因素），突发胸痛，烦躁不安，呼吸困难，听诊肺动脉瓣区P₂亢进（提示肺动脉压升高，是肺栓塞典型临床特点），综上考虑诊断为肺栓塞（A对）。坠积性肺炎（B错）症状以发热、咳嗽和咳痰为主。冠状动脉粥样硬化性心脏病（C错）导致的胸痛常有放射，且发作前常有体力劳动或情绪激动。胸腔积液（D错）大量的时候会有呼吸困难，但无突然疼痛。主动脉夹层（E错）患者会突发胸背部撕裂样剧烈疼痛，高血压是发生主动脉夹层的最重要危险因素。